前锯肌
A. 起自上6对肋骨
B. 止于肩胛骨外侧缘
C. 助臂上举
D. 使肩胛下角旋内
E. 参与平静呼吸

正确答案：C。助臂上举

解析：前锯肌起自上8或9对肋骨，而非上6对肋骨（A错），止于肩胛骨内侧缘和下角，而非肩胛骨外侧缘（B错），助臂上举（C对），使肩胛下角旋外，而非旋内（D错），助深吸气，而与平静呼吸无关（E错）。